有桡切迹的骨是
A. 肩胛骨
B. 肱骨
C. 尺骨
D. 桡骨
E. 腕骨

正确答案：C。尺骨

解析：桡切迹是尺骨的结构（C对）。尺切迹是桡骨的结构（D错）。